下列各项可作为维生素B族缺乏口角炎的诊断依据，除了
A. 双侧口角湿白色
B. 口角糜烂或溃疡
C. 舌背丝状乳头萎缩
D. 菌状乳头水肿、肥厚
E. 轮廓乳头肿大

正确答案：E。轮廓乳头肿大

解析：维生素B族缺乏常引起口角炎，尤其是后者，表现为双侧口角湿白色，有糜烂或溃疡，有横的沟裂，严重者可向内侧黏膜或皮肤延伸，沟裂深浅不一，长短不一，疼痛不明显。与口角炎同时存在的还常有唇干燥，有纵裂纹并偶见有鳞屑，唇微肿；舌背丝状乳头萎缩以致舌背平滑。但菌状乳头水肿、肥厚，呈蘑菇样，散在分布，舌缘常见有齿痕。患者感口角处有刺激性痛。因此，营养不良性口角炎，不但口角糜烂还可有唇炎、舌炎。掌握“口角炎”知识点。